刺激B细胞产生高水平抗体产生时依赖T细胞辅助的抗原是
A. 完全抗原
B. 半抗原
C. TI-Ag
D. TD-Ag
E. 共同抗原

正确答案：D。TD-Ag

解析：胸腺依赖性抗原（TD-Ag），又称T细胞依赖抗原，是刺激B细胞产生高水平抗体产生时依赖T细胞辅助的抗原。绝大多数蛋白质抗原均属TD-Ag。掌握“抗原基本概念、分类、超抗原及佐剂”知识点。